反映医患之间权利关系的正确观点是强调维护
A. 医生的权利
B. 医院院长的权利
C. 护士的权利
D. 患者的权利
E. 家属的权利

正确答案：D。患者的权利

解析：因为病人是弱势群体，所以要首先维护病人的权利。掌握“医患关系伦理”知识点。